患者，男。全身组织发育不良、易发生反复感染、易发生GVHR、易发生自身免疫病或肿瘤。该病是
A. DiGeorge（先天性胸腺发育不全）
B. SCID（重症联合免疫缺陷病）
C. WishottAldrich综合征
D. 共济失调-毛细血管扩张
E. 网状组织发育不全

正确答案：B。SCID（重症联合免疫缺陷病）

解析：SCID（重症联合免疫缺陷病）是源自骨髓干细胞的T、B细胞发育异常所致的疾病，表现为全身组织发育不良，反复发生感染，易发生移植物抗宿主反应（GVHR），易发生自身免疫病或肿瘤。掌握“免疫缺陷概述及原发性、获得性免疫缺陷病”知识点。